女性，35岁，颈前区肿块10年，近年来易出汗、心悸，渐感呼吸困难。体检：晨起心率104次/分，BP120/60mmHg，无突眼，甲状腺Ⅲ度肿大，结节状，心电图示：窦性心率不齐。确诊主要依据
A. 颈部CT
B. 血T₃、T₄值
C. 甲状腺B超
D. 颈部X线检查
E. MRI

正确答案：B。血T₃、T₄值

解析：甲亢的诊断程序为：①甲状腺毒症的诊断；②确定甲状腺毒症是否源于甲状腺功能亢进；③确定甲亢的原因。甲状腺毒症指血液循环中甲状腺激素过多，确诊主要依据为血T3、T4值（B对）。甲亢时，血清T3可高于正常4倍左右，而T4仅为正常的2倍半。颈部CT（A错）、甲状腺B超（C错）、MRI（E错）均为影像学检查，仅能了解甲状腺肿大程度及毗邻关系，但不能了解甲状腺功能状态，因而不能确诊甲亢。颈部X线检查（D错）为甲状腺手术术前检查，以了解有无气管受压或移位，不用于诊断甲亢。